同工酶的特点是
A. 催化同一底物起不同反应的酶的总称
B. 催化的反应及分子组成相同,但辅酶不同的一组酶
C. 催化作用相同，但分子结构和理化性质不同的一组酶
D. 多酶体系中酶组分的统称
E. 催化作用不同，但分子组成及理化性质均相同，但组织分布不同的一组酶

正确答案：C。催化作用相同，但分子结构和理化性质不同的一组酶

解析：同工酶是指具有相同催化功能，但酶蛋白的分子结构、理化性质和免疫学性质各不相同的一组酶。掌握“酶活性调节（抑制与激活）”知识点。